慢性再生障碍性贫血患者出现酱油色尿，最特异的诊断性检查是
A. 热溶血试验
B. 蔗糖溶血试验
C. 酸溶血试验
D. 荧光斑点试验
E. 抗人球蛋白试验

正确答案：C。酸溶血试验

解析：慢性再障患者尿呈酱油色，应考虑血红蛋白尿，血红蛋白尿常提示血管内溶血，常见于血型不合的输血反应、阵发性睡眠性血红蛋白尿等。酸溶血试验（C对）是血红蛋白尿特异性的确诊试验；热溶血试验（A错）和蔗糖溶血试验（B错）为血红蛋白尿的筛选试验，特异性不如酸溶血试验；荧光斑点试验（P554）（D错）是采用荧光法对葡萄糖6-磷酸脱氢酶进行测定，主要用于诊断蚕豆病；抗人球蛋白试验（P558）（E错）主要用于诊断温抗体性自身免疫性溶血性贫血，温抗体性自身免疫性溶血性贫血多为慢性血管外溶血。